生物多样性包括
A. 遗传多样性、物种多样性、生态系统多样性
B. 基因多样性、环境生态多样性、物种多样性
C. 生态系统多样性、环境生态多样性、物种多样性
D. 基因多样性、环境生态多样性、物种多样性
E. 遗传多样性、生态系统多样性、基因多样性

正确答案：A。遗传多样性、物种多样性、生态系统多样性

解析：本题考查生物多样性的种类。生物多样性是指地球上所有的生物如动物、植物和微生物等有规律地结合所构成的稳定生态综合体。它由生物的遗传(基因)多样性、物种多样性和生态系统多样性三部分组成（A对BCDE错）。